下颌小舌是下列哪项结构的附着位置
A. 茎突舌骨韧带
B. 颞下颌韧带
C. 翼下颌韧带
D. 茎突下颌韧带
E. 蝶下颌韧带

正确答案：E。蝶下颌韧带

解析：下颌支其内侧面中央略偏后上方有下颌孔；孔的前方有下颌小舌，为蝶下颌韧带附着处。掌握“下颌骨及腭骨解剖特点”知识点。